与α-酚羟基蒽醌类化合物呈阳性反应的是
A. Borntrager反应
B. 羟基化反应
C. 去甲基化反应
D. 氢化反应
E. 脱羧反应

正确答案：A。Borntrager反应

解析：本题考查的是Bomtrage反应。与α-酚羟基蒽醌类化合物呈阳性反应的是Borntrager反应（A对）。在碱性溶液中，羟基醌类颜色改变并加深，多呈橙、红、紫红及蓝色。如羟基蒽醌类化合物遇碱显红至紫红色，称为Bomtrage反应。羟基化反应（B错）是指向有机化合物分子中引入羟基的反应。通过羟基化反应可制得醇类与酚类化合物。通过羟基化反应可制得醇类与酚类化合物。脱甲基化（C错）是从有机物中脱去甲基的过程。最常见的是甲基醚的脱甲基化。氢化（D错）是有机化合物与氢分子的反应，在医药化工领域，氢化一般有如下两种类型：不饱和键的氢化、脱去某些保护基团。脱羧反应（E错）是羧酸失去羧基放出二氧化碳的反应。